可用于制备膜控缓释片的是
A. 羟丙基甲基纤维素
B. 单硬脂酸甘油酯
C. 大豆磷脂
D. 无毒聚氯乙烯
E. 乙基纤维素

正确答案：E。乙基纤维素

解析：本题考查缓（控）释制剂。缓控释制剂常用的不溶性包衣材料有醋酸纤维素（CA）、乙基纤维素（EC）（E对）、聚丙烯酸树脂、硅酮弹性体及交联海藻酸盐等。羟丙甲纤维素（HPMC）（A错）为亲水凝胶骨架材料。单硬脂酸甘油酯（B错）为溶蚀性骨架材料。豆磷脂（C错）为制备脂质体的材料。无毒聚氯乙烯（D错）为不溶性骨架材料。